属于长效β₂受体激动剂的平喘药是
A. 沙美特罗
B. 沙丁胺醇
C. 多索茶碱
D. 布地奈德
E. 噻托溴铵

正确答案：A。沙美特罗

解析：本题考查平喘药。属于长效β₂受体激动剂的平喘药是沙美特罗（A对）。长效β₂受体激动剂有福莫特罗、沙美特罗及丙卡特罗，平喘作用维持时间10～12h。沙丁胺醇（B错）为短效β₂受体激动剂。